男孩，13岁。右足底被铁钉刺伤，已清创，伤口已愈合。7天后发热、咳嗽、咀嚼无力、多痰，局部肌肉紧张，继而频繁四肢抽搐，一般镇静药治疗无效。为保证患者安全应立即采取的治疗措施是
A. 再扩大清创+注射TAT
B. 气管切开
C. 大剂量青霉素治疗+肠外营养
D. 隔离+避光刺激
E. 高压氧

正确答案：B。气管切开

解析：患者被铁钉刺伤（破伤风常见病因），7天后（破伤风潜伏期一般7-8天）发热、咳嗽、咀嚼无力、多痰，局部肌肉紧张，继而频繁四肢抽搐（破伤风前驱症状），诊断为破伤风。TAT（破伤风抗毒素）目的是中和游离的毒素，所以只在早期应用有效，若毒素已与神经组织结合，则难收效。该患者已经出现咀嚼无力，四肢抽搐，因此TAT无效。若累及呼吸肌和膈肌，会引起呼吸困难，且多痰，因此为保证患者安全应立即采取的治疗措施是气管切开（E对），以便改善通气。